患者，女，67岁，高血压、2型糖尿病、冠心病病史13年，既往血压最高达到180/115mmHg。规律服用氨氯地平、比索洛尔、西格列汀、二甲双胍，3年前发生缺血性脑卒中。近期记忆力下降明显，伴认知功能障碍加重入院。查体：血压155/95mmHg，心率92次/分，呼吸14次/分，体温36.5℃。意识清，少语，动作迟缓，空间感、时间感、计算力、近记忆力、定向力下降，共济运动检查欠合作；影像提示：脑内多发陈旧性缺血梗死灶、脑室扩大、脑萎缩、左侧大脑中动脉纤细合并局限性狭窄。诊断为血管性痴呆、高血压3级（很高危）、2型糖尿病、冠心病。为改善该患者脑供血不足，同时兼顾血压控制，可选用的具有阻断α受体和血管扩张作用的药物是
A. 石杉碱甲
B. 丁苯酞
C. 尼麦角林
D. 倍他司汀
E. 加兰他敏

正确答案：C。尼麦角林

解析：本题考查尼麦角林的药理作用。尼麦角林（C对）为半合成的麦角衍生物，具有较强的α受体阻断作用和血管扩张作用。